第一个用于临床的第三代喹诺酮类药物
A. 诺氟沙星
B. 盐酸环丙沙星
C. 氧氟沙星
D. 利福平
E. 盐酸乙胺丁醇

正确答案：A。诺氟沙星